新生儿在上腭中线和齿龈部位有散在黄白色、碎米粒样颗粒，称为
A. 马牙
B. 板牙
C. 螳螂子
D. 口疮
E. 鹅口疮

正确答案：A。马牙

解析：新生儿在上腭中线和齿龈部位有散在白色泡珠，形如米粒，称为马牙（A对），若泡珠较大，呈白色斑块，称为板牙（B错）。小儿口腔内近牙龈处，出现肿硬隆起的脂肪垫，剖视之颇似螳螂子者称为螳螂子（C错）。小儿齿龈、舌体、两颊、上颚等处出现黄白色溃疡，疼痛流涎，称为口疮（D错）。口腔、舌上蔓生白屑，状如鹅口，称鹅口疮（E错）。